患者因扁桃体炎给予头孢拉定治疗，服用4个小时后，面部出现皮疹，无其它不适。停药后皮疹消失，排除其它疾病可能。该病例用药与不良反应因果关系评价结果是
A. 肯定
B. 很可能
C. 可能
D. 可能无关
E. 无法评价

正确答案：B。很可能

解析：本题考查药品不良反应的评定结果。根据药品不良反应因果关系评价表可知，患者用药后面部出现皮疹的时间顺序合理，停药后皮疹消失，且排除其它疾病的可能，但题干未说明重复用药后皮疹反应出现情况，故该患者用药与皮疹出现的因果关系为“很可能”（B对）。肯定（A错）是指用药及反应发生时间顺序合理；停药以后反应停止，或迅速减轻或好转；再次使用，反应再现，并可能明显加重；有文献资料佐证；排除原患疾病等其它混杂因素影响。可能（C错）是指用药与反应发生时间关系密切，同时有文献资料佐证；但引发ADR的药品不止一种，或原患疾病的病情进展因素不能排除。可能无关（D错）是指ADR与用药时间相关性不密切，反应表现与已知该药ADR不相吻合，原患疾病发展同样可能有类似的临床表现。无法评价（E错）是指报表缺项太多，因果关系难以定论，资料又无法补充。